经上颌窦中部冠状面扫描时，可见
A. 颅中窝底部
B. 眶下裂
C. 腮腺
D. 视神经
E. 颞肌

正确答案：B。眶下裂

解析：本题考查CT检查-冠状面平扫正常图像。CT已成为医学影像检查的重要手段，在口腔颌面部主要用于颞下窝、翼腭窝、鼻窦、唾液腺、颌骨及颞下颌关节疾病等的检查。经上颌窦中部平面，可见清晰的上颌窦及其诸骨壁、眶后间隙、眶下裂（B对）、筛窦、口咽部及上下牙槽突等结构。颅中窝底部（A错）、蝶窦、茎突、下颌角、咽缩肌、翼内肌、腮腺（C错）、咽旁间隙等是经鼻咽腔冠状面扫描的可见影像。上颌窦、鼻腔、鼻甲、后组筛窦、眶后间隙及颞肌（E错）是经上颌窦后部平面的可见影像。视神经（D错）为经眼眶横断面平扫影像。